男，26岁。因车祸2小时就诊，诊断脾破裂，腹腔大量积血。就诊时血压100/60mmHg，心率110次/分。输血输液共2000ml后血压90/50mmHg，心率130次/分。除继续输血外，最佳治疗方法是
A. 注射升压药
B. 腹腔引流
C. 行脾切除手术
D. 血管造影并行脾动脉栓塞
E. 静脉输注白蛋白

正确答案：C。行脾切除手术

解析：患者脾破裂，腹腔内大量积血，紧急输血、输液2000ml后，血压反而下降，心率加快，说明仍存在出血，抗休克治疗无效，此时最佳治疗方法为行脾切除手术（C对）。因脾破裂出血量大、出血迅猛，症状危急，所以注射升压药（A错）、血管造影并行脾动脉栓塞（D错）、静脉输注白蛋白（E错）对该患者止血、升压效果有限。腹腔引流（B错）可用于将腹腔血液及时排除，降低腹膜炎的发生率，应在休克纠正之后进行。